不属于足太阴经的主治范围的是
A. 妇科病
B. 口舌病
C. 前阴病
D. 肾脏病
E. 脾胃病

正确答案：B。口舌病

解析：足太阴脾经属脾，络胃，可用于治疗胃痛、呕吐、泄泻、便秘等脾胃病证（E对）；月经过多，崩漏等妇科病（A对）；阴挺、不孕、遗精、阳痿（D对）等前阴病（C对）；以及下肢痿痹，胸胁痛等经脉循行部位的其他病证。故口舌病不属于足太阴经的主治范围（B错）。